下列钙拮抗剂中，存在手性中心的药物有
A. 硝苯地平
B. 尼莫地平
C. 尼群地平
D. 桂利嗪
E. 氨氯地平

正确答案：B、C、E。尼莫地平；尼群地平；氨氯地平

解析：本题考查尼莫地平的结构。存在手性中心的药物有尼莫地平（B对）、尼群地平（C对）、氨氯地平（E对）。尼莫地平分子中4位为手性碳原子，具有一个手性中心。尼群地平4位碳原子具手性，临床用其外消旋体。氨氯地平的4位碳原子具手性，临床用外消旋体和左旋体。硝苯地平（A错）结构对称，无手性中心。桂利嗪（D错）结构中无手性中心。